下列关于肽键性质和组成的叙述正确的是
A. 由Cα1和C-COOH组成
B. 由Cα1和Cα2组成
C. 由Cα和N组成
D. 肽键有一定程度双键性质
E. 肽键可以自由旋转

正确答案：D。肽键有一定程度双键性质

解析：肽键是连接两个氨基酸的酰胺键，由6个原子Cɑ₁、C、O、N、H、C组成（ABC错）。肽键（C-N）键长介于C-N的单键长（0.149nm）和双键长（0.127nm）之间，有一定程度双键性质（D对），不能自由旋转（E错）。